有关胶囊剂的表述，不正确的是
A. 常用硬胶囊的容积以5号为最大，0号为最小
B. 硬胶囊是由囊体和囊帽组成的
C. 软胶囊的囊壁由明胶、增塑剂、水三者构成
D. 软胶囊中的液体介质可以使用植物油
E. 软胶囊中的液体介质可以使用PEG400

正确答案：A。常用硬胶囊的容积以5号为最大，0号为最小